左侧小脑幕切迹疝发生部位是
A. 左侧基底节受压左移
B. 脑干受压左移动
C. 左侧颞叶沟回通过小脑幕切迹被推及至幕下
D. 左侧小脑幕的移位
E. 左侧小脑幕挤压脑干

正确答案：C。左侧颞叶沟回通过小脑幕切迹被推及至幕下

解析：小脑幕切迹疝发生部位是颞叶海马回、沟回通过小脑幕切迹被推及至幕下（C对）。左侧基底节受压左移（A错）、脑干受压左移动（B错）、左侧小脑幕的移位（D错）、左侧小脑幕挤压脑干（E错）均不是左侧小脑幕切迹疝发生部位。